口服给药有首过效应，生物利用度仅为50%的是
A. 盐酸吗啡
B. 盐酸哌替啶
C. 枸橼酸芬太尼
D. 盐酸美沙酮
E. 盐酸溴己新

正确答案：B。盐酸哌替啶

解析：本题考查盐酸哌替啶。盐酸哌替啶（B对）为合成的镇痛药，口服给药有首过效应，生物利用度仅为50%。盐酸吗啡（A错）的首过效应显著，癌症患者显示不同的口服生物利用度。枸橼酸芬太尼（C错）口服经胃肠道吸收，无明显首过效应。盐酸美沙酮（D错）口服吸收迅速，生物利用度为90%。盐酸溴己新（E错）分子在体内可发生环己烷羟基化、N-去甲基的代谢得到活性代谢物氨溴索，氨溴索已作为药品使用。